国务院发布《麻醉药品和精神药品管理条例》是在
A. 37106
B. 37471
C. 37836
D. 38202
E. 38567

正确答案：E。38567

解析：为加强麻醉药品和精神药品的管理，保证麻醉药品和精神药品的合法、安全、合理使用，防止流入非法渠道，2005年8月3日国务院发布了《麻醉药品和精神药品管理条例》，自2005年11月1日起施行。掌握“麻醉、精神药品的使用及法律责任”知识点。